临产后起主要作用的产力是
A. 膈肌收缩力
B. 腹肌收缩力
C. 子宫收缩力
D. 肛提肌收缩力
E. 圆韧带收缩力

正确答案：C。子宫收缩力